既能平肝潜阳、清肝明目，又能安神定惊的中药是
A. 石决明
B. 牡蛎
C. 赭石
D. 珍珠母
E. 龙骨

正确答案：D。珍珠母

解析：本题考查珍珠母的功效。既能平肝潜阳、清肝明目，又能安神定惊的中药是珍珠母（D对）。珍珠母【功效】平肝潜阳，清肝明目，安神定惊，收湿敛疮。石决明（A错）【功效】平肝潜阳，清肝明目。牡蛎（B错）【功效】平肝潜阳，镇惊安神，软坚散结，收敛固涩，制酸止痛。赭石（C错）【功效】平肝潜阳，重镇降逆，凉血止血。龙骨（E错）【功效】镇惊安神，平肝潜阳，收敛固涩，收湿敛疮。